胎儿娩出后4分钟，产妇出现多量阴道流血，最可能的诊断应是
A. 宫缩乏力
B. 阴道静脉破裂
C. 宫颈裂伤
D. 胎盘部分剥离
E. 凝血功能障碍

正确答案：D。胎盘部分剥离

解析：胎儿娩出后4分钟(10分钟内），产妇出现多量阴道流血，应考虑为胎盘因素，如胎盘部分剥离（D对）。宫缩乏力（A错）是在胎盘娩出后，出现较多的阴道流血。胎儿娩出后立即发生阴道流血，色鲜红，可考虑为宫颈裂伤（C错）。胎儿娩出后阴道持续流血，且血液不凝，才考虑为凝血功能障碍（E错）。阴道静脉破裂（B错）出血一般出血量不大，且多发生于分娩过程中。